某男，48岁，突患急性支气管炎，症见身热口渴，咳嗽痰盛，喘促气逆，胸膈满闷，医师诊断为表寒里热之咳喘。用药5天后，喘促气逆虽已，但见咳嗽痰黄黏稠，口干咽痛，大便干燥，诊其证转为痰热阻肺，治当清肺止咳，化痰通便，此时宜选用的成药是
A. 川贝止咳散
B. 蛇胆川贝散
C. 清肺抑火丸
D. 清宣止咳颗粒
E. 复方鲜竹沥液

正确答案：C。清肺抑火丸

解析：本题考查的是清肺抑火丸的功能与主治。见咳嗽痰黄黏稠，口干咽痛，大便干燥，诊其证转为痰热阻肺，治当清肺止咳，化痰通便，此时宜选用的成药是清肺抑火丸（C对）。清肺抑火丸：【功能】清肺止咳，化痰通便。【主治】痰热阻肺所致的咳嗽、痰黄黏稠、口干咽痛、大便干燥。川贝止咳散（A错）：【功能】止嗽祛痰。【主治】风热咳嗽，痰多上气或燥咳。蛇胆川贝散（B错）：【功能】清肺，止咳，祛痰。【主治】肺热咳嗽，痰多。清宣止咳颗粒（D错）：【功能】疏风清热，宣肺止咳。【主治】小儿外感风热所致的咳嗽，症见咳嗽、咯痰、发热或鼻塞、流涕、微恶风寒、咽红或痛、苔薄黄等。复方鲜竹沥液（E错）：【功能】清热化痰，止咳。【主治】痰热咳嗽，痰黄黏稠。